微囊常用的制备方法是
A. 挤出滚圆法
B. 压制法
C. 复凝聚法
D. 液中析晶法
E. 融熔法

正确答案：C。复凝聚法

解析：本题考查微囊的制备方法。微囊的制备方法：（1）物理化学法：包括单凝聚法、复凝聚法（C对）、溶剂-非溶剂法。（2）物理机械法：包括喷雾干燥法、喷雾凝结法、空气悬浮法、多孔离心法、锅包衣法。（3）化学法：包括界面缩聚法、辐射交联法。挤出滚圆法（A错）是小丸常用的制备方法。压制法（B错）是软胶囊剂常用的制备方法。液中析晶法（D错）是常用制粒方法。融熔法（E错）是固体分散体的制备方法。